有机氟类灭鼠药中毒的解救
A. 可用1：5000高锰酸钾溶液洗胃
B. 可用1.5%～2%氯化钙溶液洗胃
C. 可用5%碳酸氢钠溶液洗胃
D. 可口服氢氧化铝凝胶保护消化道黏膜
E. 可肌内注射解氟灵（乙酰胺），减轻中毒症状

正确答案：A、D、E。可用1：5000高锰酸钾溶液洗胃；可口服氢氧化铝凝胶保护消化道黏膜；可肌内注射解氟灵（乙酰胺），减轻中毒症状

解析：本题考查有机氟类灭鼠药中毒解救。有机氟类灭鼠药中毒的解救可用1：5000高锰酸钾溶液洗胃（A对），用氢氧化铝凝胶或蛋清保护消化道黏膜（D对）。特殊解毒剂乙酰胺（解氟灵）肌内注射（E对），没有乙酰胺时可以使用无水乙醇5ml溶于10%葡萄糖注射液100ml中静脉滴注，每日2～4次。1.5%～2%氯化钠溶液（B错）洗胃可用于中毒药物不明的急性中毒。5%碳酸氢钠溶液洗胃（C错）可用于急性乙醇中毒及有机磷中毒的解救。